根据《药品说明书和标签管理规定》，应当标示执行标准的是
A. 注射剂说明书
B. 原料药标签
C. 药品内标签
D. 药品外标签
E. 药品小包装标签

正确答案：B。原料药标签

解析：本题考查药品说明书和标签管理。原料药标签（B对）应当标示执行标准。